营养不良患儿应用苯丙酸诺龙的主要作用是
A. 促进消化功能
B. 促进食欲
C. 促进糖原合成
D. 促进蛋白质合成
E. 增强机体免疫功能

正确答案：D。促进蛋白质合成

解析：苯丙酸诺龙是蛋白质同化类固醇制剂，主要作用是促进蛋白质合成（D对）。